属于雌激素受体拮抗剂的药物是
A. 己烯雌酚
B. 来曲唑
C. 阿那曲唑
D. 他莫昔芬
E. 依西美坦

正确答案：D。他莫昔芬

解析：本题考查雌激素受体拮抗剂。雌激素受体拮抗剂包括他莫昔芬（D对）和托瑞米芬。